关于闭孔的说法何者错误
A. 由耻骨和坐骨共同围成
B. 有闭孔膜完全封闭
C. 内面有闭孔内肌附着
D. 外面有闭孔外肌附着
E. 有闭孔神经、血管通过

正确答案：B。有闭孔膜完全封闭

解析：耻骨与坐骨共同围成闭孔, 活体有闭孔膜封闭（A对）。闭孔膜并非完全封闭，其上部与闭孔沟围成闭膜管,有神经、血管通过（E对B错，为本题正确答案）。闭孔内面有闭孔内肌附着（C对），外面有闭孔外肌附着（D对）。